经间期出血量少，色红质黏腻，胸闷烦躁。治疗应首选
A. 知柏地黄汤
B. 清肝止淋汤
C. 血府逐瘀汤
D. 解毒活血汤
E. 逐瘀止血汤

正确答案：B。清肝止淋汤

解析：经间期出血量少，色红质黏腻为热所致，伴胸中烦躁，故为湿热而非阴虚内热。湿邪阻于冲任，蕴蒸生热，扰动冲任血海，影响固藏，故阴道出血。湿热与血搏结，故色红质黏腻。湿热熏蒸，故胸闷烦躁，辨为湿热证。知柏地黄丸功能滋阴降火，主治肝肾阴虚，虚火上炎证（A错）。经间期出血湿热证治宜清利湿热，固冲止血，方选清肝止淋汤加减（B对）。血府逐瘀汤功能活血化瘀，行气止痛，主治胸中血瘀证（C错）。解毒活血汤功能滋阴清热解毒，主治瘟毒吐泻转筋初得者（D错）。逐瘀止血汤功能化瘀止血，为经间期出血血瘀证的选方（E错）。